28岁不孕妇女，痛经3年且逐渐加重。查子宫后壁有2个触痛性硬韧结节，右侧附件区扪及超鸭卵大活动不良囊性肿物，压痛不明显，本例右侧附件区囊性肿物最可能是
A. 卵巢滤泡囊肿
B. 卵巢黄体囊肿
C. 卵巢内膜异位囊肿
D. 输卵管卵巢囊肿
E. 多囊卵巢综合征

正确答案：C。卵巢内膜异位囊肿

解析：该患者为育龄期不孕妇女（育龄期是子宫内膜异位症的高发年龄，40%的内异症患者不孕），痛经3年且逐渐加重（典型症状为继发性痛经、进行性加重），子宫后壁有2个触痛性硬韧结节，右侧附件区扪及超鸭卵大活动不良囊性肿物（双合诊检查时，可发现子宫后倾固定，直肠子宫陷凹、宫底韧带或子宫后壁下方可扪及触痛性结节，一侧或双侧附件处触及囊实性包块，活动度差），压痛不明显，诊断为子宫内膜异位症，故右侧附件区囊性肿物最可能是卵巢内膜异位囊肿（C对）。卵巢滤泡囊肿（P324）（A错）、卵巢黄体囊肿（P324）（B错）是育龄期妇女最常见卵巢瘤样病变，多为单侧，壁薄，直径≤8cm，观察或口服避孕药2～3个月，可自行消失。输卵管卵巢囊肿（P324）（D错）为炎性积液，常有盆腔炎病史。多囊卵巢综合征（P359）（E错）在临床上以雄激素过高的临床或生化表现、持续无排卵、卵巢多囊改变为特征，常伴有胰岛素抵抗和肥胖，主要表现为月经失调、雄激素过量和肥胖。